贫血最常见临床表现是
A. 窦性心动过速
B. 心脏杂音
C. 皮肤和黏膜苍白
D. 口腔炎，舌炎
E. 毛发干燥无光泽，易脱落

正确答案：C。皮肤和黏膜苍白